黄连碱具有
A. 水溶性
B. 很强的毒性
C. 明显的治疗艾滋病作用
D. 解痉镇痛作用
E. 镇咳作用

正确答案：D。解痉镇痛作用

解析：本题考查的是黄连中生物碱的药理作用。黄连碱具有解痉镇痛作用（D对）。黄连具有消炎、抑制渗出、抑制幽门螺杆菌、抗溃疡、调节胃运动、解痉止痛等多方面的作用。具有水溶性（A错）的为亲水性生物碱。主要有氧化苦参碱、麻黄碱、烟碱、秋水仙碱、咖啡碱等。具有很强的毒性（B错）的是乌头碱。乌头碱类化合物有剧毒，用之不当易致中毒，且毒性较强，0.2mg即可中毒，2～4mg即可致人死亡。具有镇咳作用（E错）的是麻黄碱。麻黄水煎液、麻黄醇提取物、麻黄生物碱、麻黄碱均具有平喘、镇咳作用。具有明显的治疗艾滋病作用（C错）的生物碱，2022年考试指南未明确说明。